产后出血最常见的原因是
A. 胎盘植入
B. 血小板减少
C. 子宫收缩乏力
D. 胎盘嵌顿
E. 胎盘粘连

正确答案：C。子宫收缩乏力

解析：产后出血最主要的原因是子宫收缩乏力（C对）。胎盘植入（A错）、胎盘嵌顿（D错）、胎盘粘连（E错）属于胎盘因素；血小板减少（B错）属于凝血功能障碍；以上四种为产后出血的主要原因，不是最常见原因。